对鲜艳的物体和声响产生定向反应是在
A. 1～2个月
B. 3～4个月
C. 4～5个月
D. 6～7个月
E. 8～9个月

正确答案：D。6～7个月

解析：本题考查感知觉的相关内容。1～2个月的婴儿仅为无条件的定向反射，3～4个月则能较长时间注意一个新鲜事物，6～7个月（D对ABCE错）对鲜艳的物体和声响产生定向反应。